畸形中央尖的患牙，除了能够见到牙齿（牙合）面上突起的畸形牙尖，X线片上还能见到
A. 牙本质呈线样透射影
B. 牙釉质呈线样透射影
C. 未发育完成呈喇叭形的根尖部
D. 髓腔枝叶状畸形
E. 根管闭锁

正确答案：C。未发育完成呈喇叭形的根尖部

解析：畸形中央尖X线检查可见髓室顶中心有向（牙合）面中央部突起的畸形部分，并常见未发育完成呈喇叭形的根尖部。中央尖折断或被磨损后，临床上表现为圆形或椭圆形黑环，中央有浅黄色或褐色的牙本质轴，在轴中央有时可见到黑色小点，此点就是髓角，但在此处即使用极细的探针也不能探入。圆锥形中央尖，萌出后不久与对颌牙接触，即遭折断，使牙髓感染坏死，影响根尖的继续发育。这
种终止发育的根尖呈喇叭形，但也有一些中央尖逐渐被磨损，修复性牙本质逐渐形成，或属无髓角伸入型。这类牙有正常的活力，牙根可继续发育。因此，发现畸形中央尖时，应根据不同情况，给
予及时相应的处理。掌握“畸形中央尖”知识点。